疮口呈空腔或伴瘘管，脓水稀薄，夹有败絮样物，见于
A. 瘰疬溃疡
B. 岩性溃疡
C. 附骨疽溃疡
D. 褥疮溃疡
E. 梅毒溃疡

正确答案：A。瘰疬溃疡

解析：瘰疬溃疡：脓水清稀，夹有败絮样物，创口呈潜行性空腔，创面肉色灰白，四周皮肤紫暗，可形成窦道（A对）。岩性溃疡（B错）疮面多呈翻花样，状如岩穴，有的在溃疡底部见有珍珠样结节，内有紫黑色坏死组织，渗流血水，伴腥臭味；附骨疽溃疡（C错）脓出稠厚，渐转稀薄，淋漓不尽，不易收口而形成窦道；压迫性溃疡（缺血性溃疡）初期皮肤暗紫，很快变黑并坏死，出现滋水、液化、腐烂，脓液有臭味，可深及筋膜、肌肉、骨膜，多见于褥疮（D错）；梅毒性溃疡（E错）疮面多呈半月形，边缘整齐，坚硬削直如凿，略微内凹，基底面高低不平，存有稀薄臭秽分泌物。